四神丸与真人养脏汤中均含有
A. 肉豆蔻
B. 肉桂
C. 补骨脂
D. 人参
E. 诃子

正确答案：A。肉豆蔻

解析：真人养脏汤组成为人参、当归、白术、肉豆蔻、肉桂、甘草、白芍、木香、诃子、罂粟壳（真人养脏诃粟壳，肉蔻当归桂木香，术芍参甘为涩剂，脱肛久痢早煎尝），四神丸组成为肉豆蔻、补骨脂、五味子、吴茱萸、生姜、大枣（四神故纸吴茱萸，肉蔻五味四般需，大枣百枚姜八两，五更肾泄火衰扶）（A对）。